患者，男，36岁。右下腹疼痛1天。患者1天前无明显诱因出现脐周疼痛，继而转移至右下腹，以手按之，其痛加剧，痛处固定不移，伴有发热，恶心，舌苔黄薄而腻，脉弦数。治疗应首选
A. 足三里、阑尾、曲池、天枢
B. 合谷、委中、天枢、太冲
C. 梁门、幽门、上巨虚、足三里
D. 合谷、三阴交、太冲、内庭
E. 上巨虚、阴陵泉、内关、合谷

正确答案：A。足三里、阑尾、曲池、天枢

解析：本题考查常见的病症的辩证、处方。题中男，36岁。右下腹疼痛1天。患者1天前无明显诱因出现脐周疼痛，继而转移至右下腹，以手按之，其痛加剧，痛处固定不移，伴有发热，恶心，舌苔黄薄而腻，脉弦数，可辩证为肠痈。足三里、阑尾、曲池、天枢等穴合用可用于治疗肠痈（A对）。合谷、委中、天枢、太冲合用可用于治疗下肢麻痹等疾病（B错）。梁门、幽门、上巨虚、足三里合用可用于治疗胃部相关疾病（C错）。合谷、三阴交、太冲、内庭合用可用于胸腹手术后疼痛（D错）。上巨虚、阴陵泉、内关、合谷合用可用于治疗细菌性痢疾等病症（E错）。